女婴，4个月。1个半月前诊断为“化脓性脑膜炎”，抗生素治疗3周后病情平稳出院。近1周患儿出现烦躁哭闹、呕吐，家长发现头颅进行性增大，前囟饱满扩大，头皮静脉扩张，头颅CT示脑室系统扩大，最可能的诊断是
A. 硬脑膜下积液
B. 脑积水
C. 脑囊肿
D. 抗利尿激素异常分泌综合征
E. 脑室管炎

正确答案：B。脑积水

解析：女性患婴，1月半前曾患化脑，待有效治疗病情平稳后，于近期出现烦躁不安、呕吐等表现，查体头颅进行性增大，前囟扩大饱满，头皮静脉扩张。头颅CT示脑室系统扩大（高度提示脑积水，系化脑炎性渗出物堵塞脑室内流出道所致）。结合患者的病史、临床表现及影像学检查，最可能的诊断是脑积水（B对）。硬脑膜下积液（A错）是最常见的化脑并发症。多发生于化脑治疗好转近期（2～3天内） ，出现如脑脊液好转但体温不降或降后再升；一般症状好转后又出现意识障碍、惊厥、颅压增高等症状。抗利尿激素异常分泌综合征（D错）系炎症剌激神经垂体致抗利尿激素过量分泌，常引起低钠血症和血浆低渗透压。脑室管炎（E错）多由治疗不及时引起，表现为抗生素治疗无效，疾病进行性加重（P379）。